染色体畸变是指
A. 基因的化学结构改变
B. 染色体数目与结构的改变
C. 易患某种疾病的素质
D. 损伤胎儿生长发育的改变
E. 免疫功能的改变

正确答案：B。染色体数目与结构的改变

解析：染色体畸变包括数目畸变和结构畸变两类（B对）。